最常见脑膜刺激征阳性的疾病是
A. 脑栓塞
B. 脑血栓形成
C. 高血压脑病
D. 短暂性脑缺血发作
E. 蛛网膜下腔出血

正确答案：E。蛛网膜下腔出血

解析：脑膜刺激征是软脑脊膜受到炎症、出血或理化内环境的改变刺激时出现的一系列提示脑膜受损的病征，其包括颈强直、克匿格征和布鲁津斯基征，病因可分为感染性和非感染性两种，后者以蛛网膜下腔出血（E对）、脑肿瘤等为主，蛛网膜下腔出血时血液会渗入脑室及脑池刺激脑膜。脑栓塞（A错）和脑血栓形成（B错）均为缺血性卒中，无脑膜刺激征表现。高血压脑病（C错）以颅内压增高为主要表现，对脑膜无刺激。短暂性脑缺血发作（D错）为局部脑缺血引起的短暂性神经功能缺损为主要表现，无脑膜刺激征。